以下不属于复合树脂的适应证的是
A. Ⅰ～Ⅴ类窝洞的修复
B. 暂时性修复体
C. 贴面、牙外形修整
D. 深度磨耗或磨牙症患者
E. 冠修复中核的构建

正确答案：D。深度磨耗或磨牙症患者

解析：复合树脂修复的适应证：复合树脂可用于临床上大部分的牙体缺损修复，其广义适应证包括：①Ⅰ～Ⅴ类窝洞的修复；②冠修复中核的构建；③窝沟封闭；④美容性修复，如贴面、牙外形修整、牙间隙封闭；⑤间接修复体的粘固；⑥暂时性修复体；⑦牙周夹板。掌握“树脂修复适应证、禁忌证与基本步骤”知识点。